侧腭突出现骨化中心的时间约是
A. 胚胎第4～5周
B. 胚胎第5～6周
C. 胚胎第6～7周
D. 胚胎第7～8周
E. 胚胎第8～9周

正确答案：E。胚胎第8～9周

解析：本题考查腭部与舌的发育。约在胚胎第8～9周（E对），在两侧上颌骨骨化中心的后方，还有一个骨化中心，为侧腭突骨化中心。